可获得常含有较多脂溶性杂质的粗制挥发油的方法是
A. 压榨法
B. 溶剂提取法
C. 水蒸气蒸馏法
D. C02超临界流体提取法
E. 盐析法

正确答案：B。溶剂提取法